折光率是
A. 折射角的角度
B. 入折射角与折射角角度的比值
C. 折射角与入射角角度的比值
D. 入射角正弦与折射角正弦的比值
E. 入射角余弦与折射角余弦的比值

正确答案：D。入射角正弦与折射角正弦的比值